男，55岁，戴下颌支架式可摘局部义齿3天，感疼痛厉害。查：右下67和左下67可摘局部义齿，舌杆连接，前部牙槽嵴舌侧为斜坡型，义齿各部与组织贴合良好。舌杆下缘处黏膜溃疡，舌杆不影响口底软组织活动。造成疼痛的原因是舌杆
A. 与黏膜贴合过紧
B. 边缘不光滑
C. 位置不当
D. 无弹性
E. 过厚

正确答案：A。与黏膜贴合过紧

解析：本题考查舌杆造成疼痛的原因。由于此患者设计的是右下67和左下67可摘局部义齿，远中游离端是黏膜支持，且前部牙槽嵴舌侧为斜坡型，在行使功能时会发生一定量的黏膜下沉，舌杆与黏膜贴合过紧（A对）义齿戴入但未行使功能时，义齿与组织贴合紧密，而发挥咀嚼功能时远中游离端下沉，舌侧的舌杆会对黏膜有一定的压力，造成压痛，易形成溃疡。若舌杆边缘不光滑（B错），则在相应位置患者会感觉不舒适，并不会引起溃疡、疼痛。若舌杆位置不当（C错）则无法到达预期效果，不一定会造成疼痛。舌杆是无弹性（D错）的合金材质铸造而成，但与疼痛无关。舌杆过厚（E错）会影响发音增加患者的不适感，不会造成疼痛。